目前对艾滋病的治疗下列各项中尚不能肯定其疗效需继续研究的是
A. 抗病毒治疗
B. 免疫治疗
C. 并发症治疗
D. 对症及支持治疗
E. 预防性治疗

正确答案：A。抗病毒治疗